以下关于药物不良反应的描述中，正确的是
A. 药物不良反应是指在正常用量、用法下发生的
B. 药物不良反应就是药物本身的毒副作用
C. 药物不良反应专指药物本身的“三”致作用
D. 大剂量服用催眠药而致中毒也是药物不良反应
E. 将氯化钾快速静脉注射而致死亡是药物不良反应

正确答案：A。药物不良反应是指在正常用量、用法下发生的

解析：本题考查药物不良反应。药品不良反应是指合格药品在正常用法用量下出现的与用药目的无关的有害反应（A对BC错）。大剂量服用催眠药（D错）不属于正常用量。氯化钾快速静脉注射（E错）不属于正常用法。